口腔黏膜有溃疡修复前首先应
A. 观察
B. 不予处理
C. 对症治疗
D. 可进行修复
E. 先取模型后治疗

正确答案：C。对症治疗

解析：治疗口腔黏膜疾病：如口腔黏膜有溃疡、白色损害等黏膜病，必须先做治疗，以免造成对黏膜的刺激，致使疾病加剧。掌握“修复前准备”知识点。